以下哪项不是人工喂养应遵循的原则
A. 选择优质乳品或乳制品为主食
B. 哺喂次数比母乳喂养少，时间间隔比母乳喂养长
C. 奶瓶及其他辅助用具应及时消毒
D. 喂养品的量和浓度要根据小儿年龄、体重计算，不能过浓
E. 喂奶前要测好温度，以温热不烫手为宜

正确答案：B。哺喂次数比母乳喂养少，时间间隔比母乳喂养长

解析：本题考查人工喂养应遵循的原则。1.选择优质乳品或乳制品为主食（A对）；2.喂奶量及次数（B错，为本题正确答案）：不同的婴儿每天需要奶量不同，奶量按婴儿体重计算，且允许每次奶量有波动，避免采取不当方法刻板要求婴儿摄入固定的奶量；3.奶瓶及其辅助用具应及时消毒（C对）：避免细菌等污染，并每次用前都及时消毒；4.奶粉的浓度（D对）：奶粉的浓度需小儿年龄、体重计算，不能过浓，也不能过稀，造成消化不良或营养不良；5.控制好奶温（E对）：喂奶前试温，可将乳汁滴几滴于手背或手腕处，以不烫手为宜；6.保持正确的喂奶姿势：喂奶时将奶瓶后部始终略高于前部，使奶水一直充满奶嘴，以免婴儿将空气吸入；7.剩下的奶要倒掉：每次吃剩下的奶一定要倒掉，奶很容易会造成细菌培养基，可导致小儿腹泄食物中毒；8.适量补充水：可利于小儿对高脂蛋白的消化吸收，也可保持宝宝大便的通畅，防止消化功能紊乱。